孕妇HBeAg（﹢），对其新生儿最好应注射
A. 丙种球蛋白
B. HBIg﹢乙型肝炎疫苗
C. 干扰素
D. 胎盘球蛋白
E. 乙型肝炎疫苗

正确答案：B。HBIg﹢乙型肝炎疫苗